肝颈静脉回流征阳性提示什么疾病
A. 左心衰
B. 右心衰
C. 肝硬化
D. 肺气肿
E. 三尖瓣关闭不全

正确答案：B。右心衰

解析：右心衰竭时可触及不同程度的肝肿大、压痛及肝颈静脉回流征（B对）。左心衰竭时以肺循环瘀血为体征，严重时可出现交替脉（A错）。肝硬化在临床上主要有肝功能减退和门静脉高压两方面表现（C错）。肺气肿主要表现为肺部异常及呼吸异常两者均不会出现肝颈静脉回流征（D错）。三尖瓣关闭不全颈静脉扩张伴收缩期搏动（E错）。